严重冠状动脉狭窄是指冠脉狭窄程度达
A. 50%以上
B. 70%以上
C. 30%以上
D. 90%以上
E. 95%以上

正确答案：B。70%以上

解析：根据八版内科学知识，冠脉狭窄根据直径变窄百分率分为四级。Ⅲ级是指冠脉狭窄程度为75%～99%，此时已达严重狭窄程度。结合本题选项，并无75%选项，故优先考虑选择最接近的70%以上（B对）。